可与盐酸-镁粉生成橙色至紫红色产物的是
A. 香豆素
B. 蒽醌
C. 黄酮
D. 皂苷
E. 生物碱

正确答案：C。黄酮

解析：本题考查的是黄酮的显色反应。可与盐酸-镁粉生成橙色至紫红色产物的是黄酮（C对）。黄酮的盐酸-镁粉（或锌粉）反应：是鉴定黄酮类化合物最常用的颜色反应。多数黄酮、黄酮醇、二氢黄酮及二氢黄酮醇类化合物显橙红色至紫红色，少数显紫色至蓝色。但查尔酮、橙酮、儿茶素则无该显色反应。异黄酮类化合物除少数例外，也不显色。香豆素（A错）能发生显色反应，可用于鉴别。香豆素的显色反应：（1）异羟肟酸铁反应；（2）三氯化铁反应；（3）Gibb's反应；（4）Emerson反应。蒽醌（B错）能发生显色反应，可用于鉴别。蒽醌的显色反应有Feigl反应、Bornträger's反应、与金属离子反应等。皂苷（D错）能发生显色反应，可用于鉴别。皂苷的显色反应：（1）Liebermann反应；（2）醋酐-浓硫酸反应；（3）三氯乙酸反应；（4）五氯化锑反应；（5）芳香醛-硫酸或高氯酸反应。生物碱（E错）能发生沉淀反应和显色反应，可用于鉴别。大多数生物碱在酸水或稀醇中与某些试剂反应生成难溶于水的络合物或复盐，这一反应称为生物碱沉淀反应，这些试剂称为生物碱沉淀试剂。常用的生物碱沉淀试剂有碘化铋钾试剂、碘化汞钾试剂、碘-碘化钾试剂、硅钨酸试剂、饱和苦味酸试剂、雷氏铵盐试剂等。某些生物碱能与一些试剂反应生成不同颜色的产物，这些试剂称为生物碱显色剂。生物碱显色试剂较多，常用的显色剂有Mandelin试剂（1%钒酸铵的浓硫酸溶液）、Macquis试剂（含少量甲醛的浓硫酸）、Frohde试剂（1%钼酸钠或钼酸铵的浓硫酸溶液）。